治湿热泻痢及下痢脓血里急后重等证，宜选用的药物是
A. 葛根
B. 连翘
C. 白芍
D. 马齿苋
E. 红藤

正确答案：D。马齿苋

解析：马齿苋性味酸寒，入肝、大肠经，功效为清热解毒，凉血止血，止痢。治疗热毒血痢；痈肿疔疮，丹毒，蛇虫咬伤，湿疹；便血，痔血，崩漏下血（D对）。葛根的功效为解肌退热，生津止渴，透疹，升阳止泻，通经活络，解酒毒。治疗外感发热头痛，项背强痛；热病口渴，消渴；麻疹不透；热泻热痢，脾虚泄泻；中风偏瘫，胸痹心痛，眩晕头痛；酒毒伤中（A错）。连翘的功效为清热解毒，消肿散结，疏散风热。治疗痈疽，瘰疬，乳痈，丹毒；风热感冒，温病初起，热入营血、高热烦渴、神昏发斑；热淋涩痛（B错）。白芍的功效为养血调经，敛阴止汗，柔肝止痛，平抑肝阳。治疗血虚萎黄，月经不调，崩漏；自汗，盗汗；胁肋脘腹疼痛，四肢挛急疼痛；肝阳上亢，头痛眩晕（C错）。红藤的功效为清热解毒，活血，祛风止痛。治疗肠痈腹痛，热毒疮疡；血滞经闭痛经，跌扑肿痛；风湿痹痛（E错）。